患者，女，28岁。患甲状腺功能亢进症半年，症见口干，心悸，腰膝酸软，耳鸣目眩，舌红少苔，脉细数。治疗应首选甲巯咪唑（他巴唑）加
A. 生脉散
B. 六味地黄丸
C. 当归补血汤
D. 丹栀逍遥散
E. 右归丸

正确答案：B。六味地黄丸

解析：痰气郁结颈前，故渐起瘿瘤；火郁伤阴，心阴亏虚，心失所养，故口干，心悸；肾阴亏虚则腰膝酸软；肝开窍于目，目失所养故见耳鸣目眩；舌红少苔，脉细数，均为心肾阴虚有热之侯，治疗应首选补益肝肾的六味地黄丸（B对）。生脉散（A错）可以益气养阴，消瘿散结，用于治疗气阴两虚证。当归补血汤（C错）用于治疗血虚证。丹栀逍遥散（D错）用肝气郁结证。右归丸（E错）用于肾阳不足证。